碱性土壤中的重金属
A. 容易被氧化而降低毒性
B. 容易被还原而降低毒性
C. 容易被作物吸收
D. 不容易被作物吸收
E. 容易被降解而降低危害

正确答案：D。不容易被作物吸收

解析：本题考查土壤pH对重金属的影响。重金属一般是以氢氧化物、离子和盐类形式存在，土壤pH越低，金属溶解度越高，越容易被植物吸收或迁移。而土壤pH偏碱性时，多数金属离子形成难溶的氢氧化物而沉淀，植物难以吸收（D对ABCE错）。